边界清楚、由富于细胞的纤维组织和表现多样的矿化组织构成的病变，且有JTOF和JPOF两种组织学病变的疾病为
A. 牙源性钙化上皮瘤
B. 牙源性角化囊性瘤
C. 骨化纤维瘤
D. 成釉细胞瘤
E. 牙瘤

正确答案：C。骨化纤维瘤

解析：骨化纤维瘤是一种边界清楚、由富于细胞的纤维组织和表现多样的矿化组织构成的病变。青少年小梁状骨化纤维瘤（JTOF）和青少年沙瘤样骨化纤维瘤（JPOF）为骨化纤维瘤的两种组织学变异型。掌握“骨化纤维瘤”知识点。